在哪种情况下，某病的患病率与发病率比值将增大
A. 病死率高
B. 该病病程短
C. 该病病程长
D. 暴露时间长
E. 该病发病率高

正确答案：C。该病病程长